门静脉高压症患者出现食管胃底曲张静脉破裂大出血，易并发
A. 肝性脑病
B. 急性肾衰竭
C. 急性肝衰竭
D. 肺水肿
E. 急性心力衰竭

正确答案：A。肝性脑病

解析：在门静脉高压症时，胃壁淤血、水肿，胃黏膜下层的动－静脉交通支广泛开放，胃黏膜微循环发生障碍，导致胃黏膜防御屏障的破坏，形成门静脉高压性胃病，发生率约20%。占门静脉高压症上消化道出血病例的5%-20%。此外，门静脉高压症时由于自身门体血流短路或手术分流，造成大量门静脉血流绕过肝细胞或因肝实质细胞功能严重受损，致使有毒物质（如氨、硫醇和γ-氨基丁酸）进入体循环，从而对脑产生毒性作用并出现精神神经综合征，称为肝性脑病。常因胃肠道出血、感染、过量摄入蛋白质、镇静药、利尿剂而诱发。曲张的食管、胃底静脉一旦破裂，立刻发生急性大出血，呕吐鲜红色血液。由于肝功能损害引起凝血功能障碍，又因脾功能亢进引起血小板减少，因此出血不易自止。由于大出血引起肝组织严重缺氧，容易导致肝性脑病（A对）。